患者，女，35岁，复杂部分发作性癫痫病史12年，最初使用苯妥英钠单药治疗，6个月前因癫痫控制不佳提高苯妥英钠剂量，因不能耐受不良反应换用卡马西平联合丙戊酸钠治疗，癫痫得到控制。患者近期出现体重增加及严重脱发，到神经内科复诊。患者同时患有2型糖尿病，长期口服二甲双胍、阿卡波糖治疗。此外患者长期服用复合维生素B。苯妥英钠可能导致的多种不良反应中，不包括
A. 共济失调
B. 低血糖
C. 视物模糊
D. 牙龈增生
E. 镇静作用

正确答案：B。低血糖

解析：本题考查苯妥英钠。苯妥英钠可能导致的多种不良反应中，不包括低血糖（B错，为本题正确答案）。苯妥英钠的不良反应有共济失调（A对），视物模糊（C对），齿龈增生（D对），镇静作用（E对）。